非处方药是
A. 不经医师处方，在医院药房购买，按医嘱服用的药品
B. 凭医师处方，到任何一个非指定的零售药店购买的药品
C. 上市的新药，对其疗效与不良反应要进一步观察的药品
D. 不需要执业医师或执业助理医师处方，可自行判断、购买及使用的药品
E. 非肠道给药的制剂，如大输液及注射剂

正确答案：D。不需要执业医师或执业助理医师处方，可自行判断、购买及使用的药品